关于磨牙应用解剖的说法下列错误的是
A. 第一磨牙萌出最早，易龋坏
B. 上下颌第一磨牙的位置关系对于建立正常咬合有重要作用
C. 第二磨牙的牙冠形态与第二乳磨牙相似
D. 第三磨牙常有先天缺失、错位萌出或阻生
E. 上颌磨牙的根尖感染有可能引起牙源性的上颌窦炎

正确答案：C。第二磨牙的牙冠形态与第二乳磨牙相似

解析：本题考查磨牙的应用解剖。第二磨牙的牙冠形态与第二乳磨牙相似（C错，为本题正确答案）不符合磨牙的应用解剖。与第二乳磨牙形态相似的是第一磨牙而非第二磨牙。第一磨牙萌出早，牙合给面窝、沟、点隙较多，易发生龋坏（A对），充填或修复时应注意恢复其正常的解剖形态。第三磨牙易发生变异，常有先天缺失或形态位置异常（D对）。上、下颌第一磨牙的位置关系在建立正常咬合过程中起重要作用（B对），应尽量保留。上颌磨牙与上颌窦关系密切，根尖感染可引起牙源性上颌窦炎（E对），断根拔除时不应使用推力，以免断根进入上颌窦。